调节腮腺分泌的副交感神经纤维源于
A. 动眼神经副核
B. 上泌涎核
C. 下泌涎核
D. 迷走神经背核
E. 无

正确答案：C。下泌涎核

解析：下泌涎核（C对）发出副交感神经的节前纤维进入舌咽神经，经其分支岩小神经至耳神经节换元，节后纤维管理腮腺的分泌，动眼神经副核（A错）发出副交感神经节后纤维支配睫状肌和瞳孔括 约肌的收缩，以调节晶状体的曲度和缩小瞳孔，上泌涎核（B错）其副交感神经节后纤维管理 泪腺、下颌下腺、舌下腺以及口、鼻腔黏膜腺的分泌 ，迷走神经背核（D错）节后纤维支配颈部、胸部所有脏器和腹腔大部分脏器的平滑 肌、心肌的活动和腺体的分泌 。